高钾血症对机体的主要危害在于
A. 引起肌肉瘫痪
B. 引起严重的肾功能损害
C. 引起血压降低
D. 引起严重的心律紊乱
E. 引起酸碱平衡紊乱

正确答案：D。引起严重的心律紊乱

解析：高钾血症所引起的肌肉瘫痪（A错）、肾功能损害（B错）、血压降低（C错）和酸碱平衡紊乱（E错）无致命性表现。高钾血症可使心肌细胞兴奋性、节律性、传导性、收缩性均降低，损害心肌功能，引起严重的心律紊乱，严重时可发生致命性心室纤颤和心搏骤停（D对）。